某日某区域空气质量指数（AQI）的各分指数为：S0₂200，NO₂90，PM₁₀160。此日该区域空气的AQI为
A. 160
B. 150
C. 200
D. 450
E. 90

正确答案：C。200

解析：本题考查AQI的计算。根据式（12-13），AQI是取空气质量分指数中最大的一项，根据题意可知本题中AQI=200（C对ABDE错）。